常见药物制剂的化学配伍变化是
A. 溶解度改变
B. 分散状态改变
C. 粒径变化
D. 颜色变化
E. 潮解

正确答案：D。颜色变化

解析：本题考查药物的配伍变化。药物制剂的化学配伍变化有变色（D对）、混浊和沉淀、产气等；物理配伍变化有溶解度改变（A错）、分散状态改变（B错）、粒径变化（C错）、潮解（E错）。